N-羟化反应常见的化合物是
A. 苯
B. 苯胺及2-乙酰氢基苯
C. 苯酚
D. 羟甲基八甲磷

正确答案：B。苯胺及2-乙酰氢基苯

解析：本题考查N-羟化反应常见的化合物。N-羟化反应常见的化合物是苯胺及2-乙酰氢基苯（B对ACD错）。